既是络穴，又是八脉交会穴的腧穴是
A. 太渊
B. 合谷
C. 后溪
D. 外关
E. 太溪

正确答案：D。外关

解析：外关既是手少阳三焦经的络穴，又是八脉交会穴，通于阳维脉（D对）。太渊既为手太阴肺经的原穴，又为脉会（A错）。合谷为手阳明大肠经的原穴（B错）。后溪为八脉交会穴，通于督脉，为手太阳小肠经的输穴（C错）。太溪为足少阴肾经的原穴（E错）。（E错）。